3岁以上儿童哮喘诊断标准不正确的是
A. 喘息呈反复发作
B. 可作肾上腺素皮下注射喘息明显缓解帮助诊断
C. 可追溯与某种变应原或刺激因素有关
D. 支气管扩张剂有明显疗效
E. 以吸气相为主的哮鸣音，呼气相延长

正确答案：E。以吸气相为主的哮鸣音，呼气相延长

解析：儿童哮喘诊断标准①反复发作喘息、咳嗽、气促或胸闷（A对），多与接触变应原、冷空气、物理或化学性刺激、呼吸道感染以及运动有关（C对）；②发作时双肺可闻及散在或弥漫性以呼气相为主的哮鸣音，呼气相延长（E错，为本题正确答案）；③上述症状和体征经抗哮喘治疗有效或自行缓解（D对）；④除外其他疾病所引起的喘息、咳嗽、气促或胸闷；⑤临床表现不典型者（如无明显喘息或哮鸣音），应至少具备以下1项：A.支气管舒张试验或运动激发试验阳虚若阳性。B.证实存在可逆性气流受限：a.支气管舒张试验阳性：吸入速效β₂受体激动剂（如沙丁胺醇）后15分钟第一秒用力呼气量（FEV1）增加≥12%；或抗哮喘治疗有效：使用支气管舒张剂和口服（或吸入）糖皮质激素治疗1～2周后，FEV1增加≥15%。C.最大呼气量每日变异率（连续监测1～2周）≥20%。符合第①～④条或④、⑤条者，可以诊断为哮喘。肾上腺素能够激动支气管平滑肌的β₂受体，使支气管平滑肌舒张，以 0.1%肾上腺素 0.01mL/kg 皮下注射（B对，E错，为本题正确答案）。